对疾病的时间、地区和人群这三方面分布的综合研究，最典型的研究方法是
A. 遗传流行病学
B. 血清流行病学
C. 移民流行病学
D. 分子流行病学
E. 理论流行病学

正确答案：C。移民流行病学